苯对造血系统产生的早期影响主要表现在
A. 白细胞减少，主要是中性粒细胞减少
B. 血象异常，以淋巴细胞减少为主
C. 血小板减少，有出血倾向
D. 淋巴细胞减少，粒细胞胞质出现中毒颗粒
E. 全血细胞减少

正确答案：A。白细胞减少，主要是中性粒细胞减少